属于五行相乘传变的是
A. 肝病及心
B. 肝病及肾
C. 肝病及肺
D. 肝病及脾
E. 脾病及心

正确答案：D。肝病及脾

解析：五行相乘是指五行中某一行对其所胜一行的过度克制，为五行之间的异常克制现象。五行相乘的次序与相克相同，即木乘土，土乘水，水乘火，火乘金，金乘木。肝属木，脾属土，肝病及脾，为木乘土，属于五行相乘传变。（D对）。肝病及心（A错），肝属木，心属火，木生火，故肝病及心，为“母病及子”。肝病及肾（B错），肝属木，肾属水，水生木，故肝病及肾，为“子病及母”。肝病及肺（C错），肝属木，肺属金，金克木，肝病及肺属于五行的相侮传变。脾病及心（E错），脾属土，心属火，火生土，故脾病及心，为“子病及母”。